镇咳作用强，在体内可部分代谢生成吗啡的药物是
A. 右美沙芬
B. 磷酸可待因
C. 羧甲司坦
D. 盐酸氨溴索
E. 乙酰半胱氨酸

正确答案：B。磷酸可待因

解析：本题考查镇咳药可待因。磷酸可待因（B对）是吗啡的3位甲醚衍生物，在肝脏代谢，代谢后约8%生成吗啡，产生成瘾性。磷酸可待因可直接抑制延脑的咳嗽中枢，镇咳作用强。右美沙芬（A错）基本结构为苯吗喃，可直接抑制延髓咳嗽中枢。主要代谢产物为3-甲氧吗啡烷、3-羟基-17-甲吗啡烷及3-羟吗啡烷；羧甲司坦（C错）为半胱氨酸类似物，是一种化痰药物；盐酸氨溴索（D错）为黏痰溶解剂；乙酰半胱氨酸（E错）为黏液溶解剂，具有较强的黏痰溶解作用，乙酰半胱氨酸是谷胱甘肽类似物，可解救对乙酰氨基酚中毒。